腭肌形成软腭的主体，由几对肌肉组成
A. 2对
B. 3对
C. 4对
D. 5对
E. 6对

正确答案：D。5对

解析：腭肌形成软腭的主体，由腭帆提肌、腭帆张肌、腭垂肌、腭舌肌和腭咽肌等5对肌肉组成。掌握“表情肌、舌腭肌”知识点。